女，67岁。因“急性广泛前壁心肌梗死”于4天前入院治疗今日患者突然喘憋，不能平卧。查体：BP120/80mmHg，心率107次/分，胸骨左缘第3肋间可触及震颤并可闻及粗糙的4/6级全收缩期杂音。该患者突发喘憋的最可能病因是
A. 乳头肌功能不全
B. 室壁瘤形成
C. 心室游离壁破裂
D. 室间隔穿孔
E. 主动脉瓣狭窄

正确答案：D。室间隔穿孔

解析：中老年男性，急性广泛前壁心肌梗死4天，今日突发喘憋（急性心肌梗死1周内突发喘憋，多由急性心肌梗死并发症引起），不能平卧。胸骨左缘第3肋间可闻及响亮的收缩期杂音伴震颤（此为急性心肌梗死并发室间隔穿孔的典型特点）（D对）。